高血压患者蛋白质摄入量应不低于总能量的
A. 0.1
B. 0.12
C. 0.15
D. 0.18
E. 0.2

正确答案：C。0.15

解析：本题考查高血压患者蛋白质摄入量。高血压患者蛋白质摄入量应不低于总能量的15%（C对ABDE错），动物性蛋白质以禽类、鱼类、牛肉等为主，多食大豆蛋白。